下列哪项不是水肿发病的常见原因
A. 风邪外袭
B. 湿毒浸淫
C. 饮食劳倦
D. 房劳过度
E. 情志内伤

正确答案：E。情志内伤

解析：风邪犯肺，肺气失于宣畅，不能通调水道，风水相博，发为水肿（A错）。外感水湿，脾阳被困，或饮食劳倦等损及脾气，造成脾失转输，水湿内停，乃成水肿（BC错）。房劳过度损及肾脏，则肾失蒸化，开阖不利，水液泛滥肌肤，则为水肿（D错）。情志内伤所及脏腑为肝，水肿的病位在肺、脾、肾，故情志内伤不是水肿发病的常见原因（E对）。